有关筛分的错误表述是
A. 物料中含湿量大，易堵塞筛孔
B. 物料的表面状态不规则，不易过筛
C. 物料的粒度越接近筛孔直径时越易过筛
D. 物料的密度小，不易过筛
E. 筛面的倾斜角度影响筛分的效率

正确答案：C。物料的粒度越接近筛孔直径时越易过筛